初孕妇，24岁。妊娠34周，剧烈头痛并抽搐一次。BP180/120mmHg，全身水肿，无宫缩，LOA，胎心150次/分，尿蛋白5g/d。该患者属于
A. 妊娠期高血压
B. 子痫前期
C. 重度子痫前期
D. 子痫
E. 妊娠合并慢性高血压

正确答案：D。子痫

解析：初孕妇，妊娠34周，剧烈头痛并抽搐一次（子痫的特异性临床表现），BP180/120mmHg（正常值为90～140/60～90mmHg，血压明显升高），全身水肿，无宫缩，LOA，胎心150次/分（正常值120～160次/分），尿蛋白5g/d（≥5g/d，提示患者大量蛋白尿），患者发生了其他原因无法解释的抽搐，所以该患者属于子痫（D对），该病属于妊娠期高血压（A错）的一种，子痫前期（B错）和重度子痫前期（C错）患者不会出现抽搐。妊娠合并慢性高血压（E错）妊娠20周前血压高于正常，妊娠期无明显加重；或妊娠20周后首次诊断高血压并持续到产后12周以后。